患者平日佩戴隐形眼镜，使用抗结核药后，导致患者隐形眼镜染色的药物是
A. 异烟肼
B. 利福平
C. 乙胺丁醇
D. 吡嗪酰胺
E. 对氨基水杨酸

正确答案：B。利福平

解析：本题考查药物的不良反应。患者平日佩戴隐形眼镜，使用抗结核药后，导致患者隐形眼镜染色的药物是利福平（B对）。利福平可致排泄物呈橘红色。异烟肼（A错）的不良反应主要有步态不稳或麻木针刺感、烧灼感或手脚疼痛（周围神经炎）、深色尿、眼或皮肤黄染、食欲不佳、异常乏力或软弱、恶心或呕吐（肝毒性的前驱症状）。乙胺丁醇（C错）主要不良反应为球后视神经炎，表现为弱视、红绿色盲和视野缩小。少数患者可出现皮疹、药热等过敏反应。吡嗪酰胺（D错）长期大量使用可引起肝损害，表现为氨基转移酶升高、黄疸、肝细胞坏死等。本品也可引起高尿酸血症、胃肠道反应、过敏反应等。对氨基水杨酸（E错）不良反应较多。常见胃肠道反应，也可引起皮疹、发热、关节痛、白细胞减少症和肝肾损害等。